存在于抗原分子表面的，决定抗原特异性的特殊的化学基团称之为
A. 抗原表位
B. 异嗜性抗原
C. 抗原结合价
D. 类属抗原
E. Forssman抗原

正确答案：A。抗原表位

解析：抗原表位或称表位是抗原分子中决定抗原特异性的特殊化学基团，也是与TCR或抗体或BCR特异性结合的结构。掌握“抗原基本概念、分类、超抗原及佐剂”知识点。